感应传导信息与气的作用有关的是
A. 固摄作用
B. 中介作用
C. 推动与调控作用
D. 温煦与凉润作用
E. 防御作用

正确答案：B。中介作用

解析：气的中介作用是指气能感应传导信息以维系机体的整体联系（B对）。气的温煦作用，能够温煦机体；气的凉润作用，能够凉润机体，二者与维持人体相对恒定体温关系密切（D错）。气的防御作用是指气既能护卫肌表，防御外邪入侵，同时也可以祛除侵入人体内的病邪（E错）。气的固摄作用是指气对体内血、津液、精等液态物质的固护、统摄和控制作用，防止其无故流失，保证它们发挥正常的生理作用（A错）。气的推动作用主要体现在：激发和促进人体的生长发育及生殖机能；激发和促进各脏腑经络的生理机能；激发和促进精血津液的生成及运行输布；激发和兴奋精神活动（C错）。